根据《处方药与非处方药流通管理暂行规定》的规定
A. 药品生产、批发企业可以直接向病患者推荐、销售处方药
B. 乙类非处方药零售业务可由普通商业企业经营
C. 处方药不得开架自选销售
D. 非处方药可以开架自选销售
E. 非处方药不得采用有奖销售方式

正确答案：B、C、D、E。乙类非处方药零售业务可由普通商业企业经营；处方药不得开架自选销售；非处方药可以开架自选销售；非处方药不得采用有奖销售方式

解析：本题考查《处方药与非处方药流通管理暂行规定》。根据《处方药与非处方药流通管理暂行规定》：（1）在在药品零售网点数量不足、布局不合理的地区，普通商业企业可以销售乙类非处方药（B对），但必须经过当地地市级以上药品监督管理部门审查、批准、登记，符合条件的颁发乙类非处方药准销标志；（2）处方药、非处方药分区陈列，并有处方药、非处方药专业标识，处方药不得开架自选销售（C对），非处方药可以开架自选销售（D对）；（3）处方药、非处方药不得采用有奖销售方式（E对）、附赠药品或礼品销售等销售方式。